发热时机体不会出现
A. 物质代谢率增高
B. 糖原分解代谢加强
C. 脂肪分解代谢加强
D. 蛋白质代谢正氮平衡
E. 心率加快

正确答案：D。蛋白质代谢正氮平衡

解析：体温升高时物质代谢加快，体温每升高1°C，基础代谢率增高（A对）13%。发热时由于产热的需要，能量消耗大大增加，糖（B对）、脂肪（C对）和蛋白质的分解代谢加强，其中尿氮比正常人增加约2 -3倍。此时如果未能及时补充足够的蛋白质，将产生负氮平衡（D错，为本题正确答案）。另外发热也会引起心率加快（E对），体温每上升1°C，心率约增加18次／分。